为几无抗炎作用的解热镇痛抗炎药
A. 美洛昔康
B. 双氯芬酸
C. 保泰松
D. 吡罗昔康
E. 扑热息痛

正确答案：E。扑热息痛